以下哪种现场调查是最为常用的方式
A. 面谈法
B. 信函调查法
C. 电话调查法
D. 集中调查法

正确答案：A。面谈法

解析：本题考查最为常用的现场调查方式。面对面访谈（A对BCD错）是由调查者到调查现场找到被调查者，按照问卷条目逐项询问被调查者，根据其回答填写调查间卷，完成调查。其基本特征是有详细的调查表和进行面对面的访问，是社会医学研究中最常用的问卷调查方法。